营养、体育锻炼、疾病属于影响生长发育的
A. 遗传因素
B. 生物性因素
C. 非生物性因素
D. 生物性因素与非生物性因素
E. 家庭生活质量

正确答案：B。生物性因素